按药物性质分类，属于含液体成分散剂的是
A. 银翘散
B. 川芎茶调散
C. 避瘟散
D. 九分散
E. 蛇胆川贝散

正确答案：E。蛇胆川贝散

解析：本题考查的是散剂的分类。按药物性质分类，属于含液体成分散剂的是蛇胆川贝散（E对）。散剂按药物性质分类：可分为普通散剂和特殊散剂。特殊散剂又分为含毒性药散剂，如九分散（D错）等；含低共熔成分散剂，如含有樟脑和薄荷脑的痱子粉、含有薄荷脑和冰片的避瘟散（C错）等；含液体成分散剂，如蛇胆川贝散等。银翘散（A错）属于复方散剂。复方散剂是由两种或两种以上的药物组成，如参苓白术散、银翘散等。川芎茶调散（B错）属于内服散剂。内服散剂，有川芎茶调散等。